根据《中华人民共和国传染病防治法》下列疾病中要采取甲类传染病的预防、控制措施的是
A. 麻疹
B. 血吸虫
C. 肺炭疽
D. 黑热病
E. 登革热

正确答案：C。肺炭疽